含有羰基，易与生物大分子形成氢键，增强与受体结合能力的基团是
A. 烃基
B. 卤素
C. 醚
D. 酰胺基
E. 羟基

正确答案：D。酰胺基

解析：本题考查药物官能团。酰胺（D对）含羰基，能够增加亲和力；易与生物大分子形成氢键，增加结合能力。